骨碎补去毛的方法是
A. 刷
B. 燎
C. 刮
D. 烫
E. 撞

正确答案：E。撞

解析：本题考查的是骨碎补的炮制方法。骨碎补去毛的方法是撞（E对）。去毛：药材表面或内部的绒毛、鳞片、硬刺、根类药材的须根以及动物类药材的茸毛等具刺激咽喉等副作用，故须除去。如骨碎补等根茎类中药表面生有茸毛（鳞片），可先用砂烫法将毛烫焦，再撞净、筛除；鹿茸，加工时先用火燎（B错）去茸毛，再将其表面刮净（C错）。部分叶类药材如枇杷叶下表面密被绒毛，可在产地采摘后趁鲜用棕刷刷（A错）去绒毛。金樱子内部生有淡黄色绒毛，一般在产地趁鲜纵剖二瓣，用刀挖净毛、核。或者将干燥后的金樱子略浸、润透，纵切二瓣，除去毛核，干燥。